正确的是
A. 起于肩胛骨的喙突和盂下结节
B. 受桡神经支配
C. 止于尺骨鹰嘴
D. 能屈肩关节伸肘关节
E. 以上都不是

正确答案：E。以上都不是

解析：肱二头肌起于肩胛骨的喙突和盂上结节，而非肩胛骨的喙突和盂下结节（A错），止于桡骨粗隆，而非尺骨鹰嘴（C错），受肌皮神经支配，而非桡神经（B错），能屈肩关节和屈肘关节，而非伸肘关节（D错，故E为本题正确答案）。